附子中去甲乌药碱强心作用的机制是
A. 兴奋α受体
B. 促进Ca²⁺
C. 阻M
D. 抑ATP
E. 兴奋β受体

正确答案：E。兴奋β受体

解析：本题考查的是去甲乌药碱强心作用的机制。附子中去甲乌药碱强心作用的机制是兴奋β受体（E对）。附子中的消旋去甲乌药碱是强心成分，是β受体部分激动剂。